男，72岁。排便时突然跌倒，呼之不应。诊断为心脏骤停。有陈旧心肌梗死和糖尿病病史。该患者心脏骤停最可能的病因是
A. 高钾血症
B. 心包填塞
C. 心脏破裂
D. 肺栓塞
E. 冠状动脉粥样硬化性心脏病

正确答案：E。冠状动脉粥样硬化性心脏病

解析：患者老年男性，有陈旧心肌梗死和糖尿病病史，故其心脏骤停最可能的病因是冠状动脉粥样硬化性心脏病（E对）。高钾血症（A错）常有四肢及口周感觉麻木，极度疲乏，肌肉酸疼，肢体苍白湿冷等表现。心包填塞（P305）（B错）多伴有急性心包炎病史。心脏破裂（P240）（C错）为急性心肌梗死的并发症，常伴有面色苍白、呼吸浅弱、脉搏细速、血压下降等休克表现。肺栓塞（P100）（D错）多表现为突发的呼吸困难、胸痛及咯血等。